妊娠期高血压妇女宜选用的药品是
A. 福辛普利
B. 利血平
C. 厄贝沙坦
D. 阿利吉仑
E. 甲基多巴

正确答案：E。甲基多巴

解析：本题考查甲基多巴。妊娠期高血压妇女宜选用的药品是甲基多巴（E对）。治疗妊娠期高血压第一线的药物是甲基多巴，第二线的药物包括α-和β-受体阻滞剂，它们可以辅助第一线的药物联合使用，从而降低第一线药物剂量过大所致的副作用。福辛普利（A错）为血管紧张素转换酶抑制剂，是伴有左心室肥厚、左心功能障碍、急性心肌梗死、糖尿病肾病的高血压患者的首选药。利血平（B错）适用于治疗高血压及高血压危象，但利血平可透过胎盘屏障，可能引起胎儿呼吸道分泌物增多、鼻充血等，故妊娠期妇女禁用。厄贝沙坦（C错）为血管紧张素Ⅱ受体阻断剂，用于原发性高血压，妊娠初始3个月内不宜使用，哺乳期妇女禁用。阿克利仑（D错）为肾素抑制药，慎用于妊娠及哺乳期妇女。